腺源性感染主要来源是
A. 腮腺
B. 颌下腺
C. 舌下腺
D. 淋巴结
E. 扁桃体

正确答案：D。淋巴结

解析：本题考查口腔颌面部感染的途径。口腔颌面部感染的途径主要有5种：牙源性、腺源性、血源性、医源性和损伤性。面颈部的淋巴结较为丰富，这些淋巴结既可继发于口腔、上呼吸道感染引起炎症改变；淋巴结（D对）感染又可穿过淋巴结被膜向周围扩散，引起筋膜间隙的蜂窝织炎，这种感染途径称为腺源性感染。腮腺、下颌下腺、扁桃体周围含有丰富的淋巴结，当口腔颌面部发生感染时，它们可以成为感染病灶并导致炎症的扩散，主要发生于淋巴结未成熟的婴幼儿。所以腺源性感染的来源不是腮腺（A错）、颌下腺（B错），也不是扁桃体（E错），而是它们周围的淋巴结。